腰麻术后出现急性尿潴留，最常用的处理方法是
A. 热敷
B. 耻骨上膀胱穿刺抽吸尿液
C. 耻骨上膀胱造瘘
D. 导尿
E. 针灸

正确答案：D。导尿

解析：由于支配膀胱的副交感神经很细，对局麻药很敏感，阻滞后恢复较晚，可造成尿潴留。急性尿潴留属于急症，临床上解除急性尿潴留最常用的处理方法为导尿（D对），可迅速引流膀胱尿液、解除病痛。当病人不能插入尿管时，可用耻骨上膀胱穿刺抽取尿液（B错），以暂时缓解病人痛苦，但不作为最常用的方法。耻骨上膀胱造瘘（C错）为永久性引流尿液的措施，一般用于长期尿潴留患者。对于腰麻术后出现尿潴留还可以进行热敷（A错）、针灸（E错）及注射副交感神经兴奋药恢复副交感神经兴奋性的治疗措施，但其效果较迟缓。